大便中夹有不消化的食物，酸腐臭秽，其常见病因是
A. 肝脾不调
B. 寒湿内盛
C. 大肠湿热
D. 脾胃虚弱
E. 食滞胃肠

正确答案：E。食滞胃肠

解析：肝脾不调导致的大便异常为大便时干时稀（A错）。寒湿内盛导致的大便异常为大便清稀，甚如水样（B错）。大肠湿热导致的大便异常可见泄泻暴作，泻下不爽，可见便血（C错）。脾胃虚弱导致的大便异常为便溏（D错）。大便中夹有不消化食物的症状，即完谷不化，伴酸腐臭秽者，为实证，见于食滞肠胃（E对）。